艾滋病属于哪种病原体感染
A. 革兰阴性菌
B. 革兰阳性菌
C. 真菌
D. DNA病毒
E. RNA病毒

正确答案：E。RNA病毒

解析：艾滋病属于单链RNA病毒（E对），属于反转录病毒科，慢病毒属中的人类慢病毒组。革兰阴性菌（A错）包括痢疾杆菌、伤寒杆菌、大肠杆菌、变形杆菌、绿脓杆菌等。革兰阳性菌（B错）包括葡萄球菌、链球菌、肺炎双球菌、炭疽杆菌等。真菌（C错）包括酵母菌、白地霉等。DNA病毒（D错）包括人乙型肝炎病毒、流感病毒等。